患者女，58岁，牙列缺失，要求修复。若患者在义齿戴入后反映下颌弥漫性疼痛、肌肉酸痛、其原因是
A. 基托组织面未对骨突、骨嵴进行有效缓冲
B. 垂直距离过高
C. 咬合有个别牙早接触
D. 黏膜过薄
E. 牙槽嵴窄而低平

正确答案：B。垂直距离过高

解析：本题考查无牙颌的印模与模型。垂直距离过高（B对）：患者戴义齿后，感到下颌牙槽嵴普遍疼痛或压痛，不能坚持较长时间戴义齿，面颊部肌肉酸痛，上腭部有烧灼感。